关于孕激素作用的叙述下列哪项错误
A. 刺激子宫内膜呈增生期变化
B. 使子宫肌活动减弱
C. 降低母体免疫排斥反应
D. 刺激乳腺腺泡的发育
E. 促进能量代谢，有产热作用

正确答案：A。刺激子宫内膜呈增生期变化